四缝穴的定位是
A. 手2～5指掌侧，掌指关节横纹中点处
B. 手1～4指掌侧，指骨间关节横纹中点处
C. 手1～4指掌侧，近端指骨间关节横纹中央
D. 手1～5指间，指蹼缘后方赤白肉际处
E. 手2～5指掌侧，近端指骨间关节横纹中央

正确答案：E。手2～5指掌侧，近端指骨间关节横纹中央

解析：四缝穴位于第2-5指掌面近侧指间关节横纹的中央（E对），主要治疗小儿疳积、百日咳、小儿腹泻、蛔虫症。